某男，55岁，有糖尿病史，口渴引饮，能食与便溏并见，精神不振，四肢乏力；舌质淡，苔薄白，脉细弱。根据辨证结果，应采用的治法是
A. 清胃泻火
B. 滋养肾阴
C. 健脾益气
D. 清肝泻火
E. 阴阳双补

正确答案：C。健脾益气

解析：本题考查的是消渴的辨证论治。有糖尿病史，口渴引饮，能食与便溏并见，精神不振，四肢乏力；舌质淡，苔薄白，脉细弱。根据辨证结果，应采用的治法健脾益气（C对）。消渴是以多饮、多食、多尿、乏力、消瘦，或尿有甜味为主要临床表现的疾病。其中以口渴多饮为主者称为“上消”；消谷善饥为主者称为“中消”；小溲多而频，或浑浊为特点的称为“下消”。三者也可并见。西医学的糖尿病、尿崩症和精神性多饮、多尿症等以上述临床表现为主者，均可参考此内容辨证论治。（一）阴虚燥热证：【症状】烦渴引饮，消谷善饥，小便频数而多，尿浑而黄，形体消瘦，舌红，苔薄黄，脉滑数。【治法】养阴润燥。（二）脾胃气虚证：【症状】口渴引饮，能食与便溏并见，或饮食减少，精神不振，四肢乏力。舌淡，苔薄白而干，脉细弱无力。【治法】健脾益气。（三）气阴两虚证：【症状】口渴引饮，能食与便溏并见，或饮食减少，精神不振，四肢乏力，体瘦。舌质淡红，苔白而干，脉弱。【治法】益气健脾，生津止渴。（四）肾阴亏虚证：【症状】尿频量多，浊如膏脂，腰酸膝软，头晕耳鸣，多梦遗精，乏力，皮肤干燥。舌红少苔，脉细数。【治法】滋养肾阴（B错）。（五）阴阳两虚证：【症状】小便频数，甚则饮一溲一，咽干舌燥，面容憔悴，耳轮干枯，腰膝酸软，畏寒肢冷。舌淡，苔白少津，脉沉细无力。【治法】温阳滋肾。治法为清胃泻火（A错）、清肝泻火（D错）或阴阳双补（E错）的病证，2022年考试指南未明确说明。